有关釉质的特点，不正确的是
A. 基质中含有胶原
B. 抗磨性强
C. 无细胞
D. 高度矿化的硬组织
E. 上皮细胞分泌

正确答案：A。基质中含有胶原

解析：本题考查釉质的特点。釉质基质由单一的蛋白质构成，不含胶原（A错，为本题的正确答案），为覆盖于牙冠的高度矿化的硬组织（D对），耐磨性强（B对），是龋病最先侵及的组织，也是全身唯一无细胞性（C对）、由上皮细胞分泌（E对）矿化的组织。